药物的化学结构决定了药物的理化性质，体内过程和生物活性，由化学结构决定的药物性质包括
A. 药物的ED₅₀
B. 药物的pKₐ
C. 药物的旋光度
D. 药物的LD₅₀
E. 药物的t1/2

正确答案：A、B、C、D、E。药物的ED₅₀；药物的pKₐ；药物的旋光度；药物的LD₅₀；药物的t1/2

解析：本题考查药物的理化性质与药物活性。由化学结构决定的药物性质包括：药物的ED₅₀（A对）、药物的pKₐ（B对）、药物的旋光度（C对）、药物的LD₅₀（D对）和药物的t1/2（E对）。pKₐ是氢离子浓度的负对数酸度系数，代表一种酸离解氢离子的能力，由化学结构决定；药物的旋光度与药物的结构有关，如有些药物含有手性碳原子，具有光学活性；生物半衰期是指药物在体内的量或血浆药物浓度下降一半所需要的时间；药物的ED₅₀是药物的半数有效量，药物LD₅₀为药物的半数致死量。